肾盂肾炎脾肾气虚证的治法是
A. 疏利气机，通利小便
B. 健脾益肾，通淋泄浊
C. 补脾升清，益气利水
D. 温阳益气，补肾利水
E. 理气疏导，利尿通淋

正确答案：B。健脾益肾，通淋泄浊

解析：肾盂肾炎脾肾气虚证的治疗需健脾益肾，通淋泄浊（B对）。疏利气机，通利小便（A错）是气淋的治法。补脾升清，益气利水（C错）是劳淋的治法。温阳益气，补肾利水（D错）是肾阳虚的治法。理气疏导，利尿通淋（E错）是气淋的治法。